在突发环境污染事件的应急监测中，其现场采样监测仪器设备的选择、确定原则不包括
A. 能尽快鉴定、鉴别污染物的种类
B. 能作出定性或半定量结果
C. 能直接读数、操作便捷
D. 对样品前处理要求简单
E. 便于携带的国外进口仪器

正确答案：E。便于携带的国外进口仪器

解析：本题考查在突发环境污染事件的应急监测中，现场采样监测仪器设备的选择、确定原则。在突发环境污染事件的应急监测中应以尽快鉴定、鉴别污染物的种类（A对），并能做出定性或半定量结果（B对）为原则。因此，应该选择那些直接读数、操作便捷（C对）、易于携带、对样品前处理要求简单的仪器（D对）。便于携带的国外进口仪器（E错，为本题正确答案）不是现场采样监测仪器设备的选择、确定原则。